某患者主诉左侧面部感觉麻痹，刺激左眼角膜而左眼眨眼反射消失，但刺激右眼角膜，左眼眨眼反射正常。此外，病人下颌前突时偏向左侧，身体对侧痛温觉丧失，以及粗意向震颤和倾向左侧跌倒。该病人粗意向震颤和倾向左侧跌倒是由于病变累及
A. 左桥小脑纤维
B. 右桥小脑纤维
C. 左脊髓丘脑束
D. 右脊髓丘脑束
E. 锥体交叉以上的左锥体束

正确答案：A。左桥小脑纤维

解析：患者主诉左侧面部感觉麻痹，刺激左眼角膜而左眼眨眼反射消失，是三叉神经损伤的表现。左桥小脑纤维的表现为同侧粗意向震颤和倾向左侧跌倒（A对）。